女性，78岁，因生气导致言语发生异常就诊，若考虑脑出血的话，则首选的辅助检查方法为
A. X线片
B. 脑电图
C. 头颅弥散加权MRI
D. 头颅CT
E. PETCT

正确答案：D。头颅CT

解析：脑部缺血性卒中极早期的头颅CT常正常，而MRI对早期识别脑梗死非常敏感（尤其是弥散加权成像）。头颅CT是发现和诊断脑出血的首选方法。掌握“脑卒中”知识点。